甲磺酸伊马替尼是治疗慢性粒细胞白血病的抗肿瘤药，其作用靶点是
A. 二氢叶酸还原酶
B. 拓扑异构酶
C. 蛋白酪氨酸激酶
D. 胸腺嘧啶核苷酸合成酶
E. 腺酰琥珀酸合成酶

正确答案：C。蛋白酪氨酸激酶

解析：本题考查抗肿瘤药的作用靶点。第一个上市的蛋白酪氨酸激酶（C对）抑制剂是甲磺酸伊马替尼，在体内外均可在细胞水平上抑制”费城染色体”的Bcr-Abl酪氨酸激酶，能选择性抑制Bcr-Abl阳性细胞系细胞、 Ph染色体阳性的慢性粒细胞白血病和急性淋巴细胞白血病病人的新鲜细胞的增殖和诱导其凋亡。